慢性、反复发作并呈节律性上腹疼痛是
A. 高血压的临床表现
B. 糖尿病的临床表现
C. 高脂血症的临床表现
D. 消化性溃疡的临床表现
E. 支气管哮喘的临床表现

正确答案：D。消化性溃疡的临床表现

解析：本题考查消化性溃疡的临床表现。消化性溃疡的临床表现（D对）有慢性、反复发作并呈节律性上腹疼痛。高血压的临床表现（A错）有头痛、头晕、心悸。糖尿病的临床表现（B错）大多无明显症状，部分可有多饮、多尿、多食、消瘦和体重减轻等。高脂血症的临床表现（C错）有黄色瘤及动脉硬化等。支气管哮喘的临床表现（E错）为发作性伴有哮鸣音的呼气性呼吸困难。